痰火扰神与痰蒙心神的共有特征
A. 狂躁
B. 抑郁
C. 痴呆
D. 神昏
E. 错语

正确答案：D。神昏

解析：痰火扰神，痰火蔽窍，扰乱神志，故神昏谵语；痰蒙心神，痰浊蒙蔽，心神不清，故见神情痴呆，意识模糊，甚则昏不知人（D对）；狂躁是痰火扰神具有，痰蒙心神不具有的临床表现（A错）；抑郁（B错）、痴呆（C错）是痰蒙心神具有，痰火扰神不具有的临床表现；错语是心气不足或痰浊、瘀血、气郁等阻碍心神所致的临床表现，不见于痰扰神证（E错）。